病人不断地无目的地重复某些简单的言语，该症状为
A. 赘述症
B. 持续言语
C. 模仿言语
D. 刻板言语
E. 思维散漫

正确答案：D。刻板言语

解析：病人不断地无目的地重复某些简单的言语（思维在原地踏步，概念转换困难，并且脑中概念相对较少）是刻板言语的表现（D对）。赘述症表现为患者对某种事物做不必要的过分的详尽的描述，言语啰嗦，但最终能够回答出有关问题（A错）。持续言语是指思维活动在某一概念上停滞不前，表现为给患者提出一系列问题时，每次重复第一次回答时所说的话（B错）。模仿言语是指刻板地模仿周围人的言语（C错）。思维散漫的患者表现为缺乏主题，别人都不理解他所要阐述的主题思想是什么（E错）。